预防人群碘缺乏病的最方便而实用的措施是
A. 在食盐中加入碘化钾或碘酸钾
B. 在食用油中加入碘盐
C. 消除其他致甲状腺肿的物质
D. 净化或更换水源
E. 服用含碘药物

正确答案：A。在食盐中加入碘化钾或碘酸钾

解析：本题考查预防人群碘缺乏病的最方便而实用的措施。碘缺乏病是指从胚胎发育至成人期由于碘摄入量不足而引起的一系列病症。食盐加碘（A对BCDE错）是预防碘缺乏病的首选方法，而且是最易坚持的有效措施，该方法简便、经济、安全可靠。